关于上颌结节注射法说法错误的是
A. 注射针进入3.5cm
B. 注射方向向上后内
C. 用于上颌磨牙拔除
D. 注入2ml
E. 麻醉上颌后神经

正确答案：A。注射针进入3.5cm

解析：本题考查上牙槽后神经阻滞麻醉。关于上颌结节注射法说法错误的是注射针进入3.5cm（A错，为本题的正确答案）。（1）上牙槽后神经阻滞麻醉注射局麻药液于上颌结节，以麻醉上牙槽后神经（E对），又称上颌结节注射法。本法适用于上颌磨牙的拔除（C对）以及相应的颊侧牙龈、黏膜和上颌结节部的手术。（2）一般以上颌第二磨牙远中颊侧口腔前庭沟为进针点；在上颌第二磨牙未萌出的儿童，则以第一磨牙远中颊侧前庭沟为进针点；在上颌磨牙缺失的患者，则以颧牙槽嵴部的前庭沟为进针点。（3）注射时，患者取坐位，头微后仰，上颌牙平面与地面成45°角，半张口。术者用口镜将口颊向后上方牵开以显露针刺点，注射针与上颌牙长轴成40°角，向上后内方刺入（B对）。进针时针尖沿着上颌结节弧形表面滑动，深约1.5～1.6cm。针尖刺入不宜过深，以免刺破上颌结节后方的翼静脉丛引起血肿。回抽无血后注入麻醉药液1.5～2mL（D对）。